以研究各种精神疾病的病因、发病机制、临床表现、疾病发展规律以及诊断、治疗和预防的一门学科，称为
A. 精神障碍症状学
B. 精神病学
C. 医学心理学
D. 流行病学
E. 神经病学

正确答案：B。精神病学

解析：精神病学是临床医学的一个分支，它是以研究各种精神疾病的病因、发病机制、临床表现、疾病发展规律以及诊断、治疗和预防的一门学科。掌握“精神障碍概述”知识点。